女孩，13岁。发热2周余，胸闷，心慌，双膝关节肿痛1个月，前一周有咽痛史，心电图示P-R间期延长，血沉50mm/h。患者的药物治疗首选
A. 免疫抑制剂
B. 阿司匹林
C. 泼尼松
D. 青霉素
E. 强心药物

正确答案：C。泼尼松

解析：风湿性心脏炎时宜早期使用泼尼松。根据题目中所给出的一系列条件：发热、“上感”病史、双膝关节肿痛、心电图示P-R间期延长，血沉50mm/h。不难诊断出该小儿为风湿热患儿，同时有风湿性心脏炎和关节炎的表现。风湿性心脏炎时宜早期使用糖皮质激素，如泼尼松（C对）等，无心脏炎的患儿可使用水杨酸制剂，如阿司匹林（B错）等一系列的非甾体抗炎药。洋地黄类强心药物（E错），不良反应较多，小儿急性风湿热所引起的心力衰竭，忌用或慎用强心甙类药物。青霉素（D错）类抗生素主要用来清除链球菌感染，以及预后和预防。免疫抑制剂（A错）可用于治疗小儿哮喘，而不是风湿性心脏炎。